欲把毒理学剂量反应关系中常见的非对称S状曲线转换为直线，需要将
A. 纵坐标用对数表示，横坐标用反应频数表示
B. 纵坐标用概率单位表示，横坐标用对数表示
C. 纵坐标用对数表示，横坐标用概率单位表示
D. 纵坐标用反应频数表示，横坐标用概率单位表示
E. 纵坐标用概率单位表示，横坐标用反应频数表示

正确答案：B。纵坐标用概率单位表示，横坐标用对数表示